患者，男，49岁，平素体健，因感冒服药后出现血压升高，可能引起此反应的药物是
A. 氨溴索
B. 对乙酰氨基酚
C. 右美沙芬
D. 喷托维林
E. 伪麻黄碱

正确答案：E。伪麻黄碱

解析：本题考查药物不良反应。伪麻黄碱（E对）通过收缩血管平滑肌，使血压升高。氨溴索（A错）不良反应为轻微的上部胃肠道反应。对乙酰氨基酚（B错）不良反应为药源性肝脏损害。右美沙芬（C错）可引起嗜睡。喷托维林（D错）可使驾驶员出现眩晕或幻觉。